在饮水消毒中，用一般消毒方法很难将其全部杀死的微生物是
A. 隐孢子虫卵囊
B. 痢疾杆菌
C. 霍乱弧菌
D. 贾第鞭毛虫
E. 甲型肝炎病毒

正确答案：D。贾第鞭毛虫

解析：本题考查用一般饮水消毒方法很难将其全部杀死的微生物。贾第鞭毛虫（D对ABCE错）是寄生于人类和动物肠道的原生动物，一般消毒方法很难将其全部杀死。人感染贾第鞭毛虫后可出现腹痛、腹泻和吸收不良等症状。贾第鞭毛虫病也是最有可能通过水源或饮水而传播的介水传染病之一。